疼痛不甚剧烈而绵绵不休者，称为
A. 重痛
B. 隐痛
C. 灼痛
D. 空痛
E. 冷痛

正确答案：B。隐痛

解析：隐痛常表现为疼痛不剧烈，尚可忍耐，但绵绵不休。多因阳气精血亏虚，脏腑经脉失养所致（B对）。重痛常表现为疼痛兼有沉重感，多因湿邪困阻气机所致（A错）。灼痛常表现为疼痛有灼热感而喜凉（C错）。空痛常表现为疼痛兼有空虚感，多因气血亏虚，阴精不足，脏腑经脉失养所致，常见于头部或小腹部等处（D错）。冷痛常表现为疼痛有冷感而喜暖，寒邪阻滞经络所致者，为实证；阳气亏虚，脏腑经脉失于温煦所致者，为虚证（E错）。